社会经济发展对健康的作用是
A. 促进作用
B. 抑制作用
C. 线性正相关
D. 线性负相关
E. 没有影响

正确答案：A。促进作用